关于传染病的治疗原则，错误的是
A. 坚持综合治疗原则
B. 重视病原治疗，有没有一般治疗不重要
C. 治疗、护理与隔离、消毒并重
D. 一般治疗、对症治疗与病原治疗结合
E. 中医中药治疗

正确答案：B。重视病原治疗，有没有一般治疗不重要

解析：传染病的治疗要坚持综合治疗的原则（A对），即治疗、护理与隔离、消毒并重（C对），一般治疗、对症治疗与病原治疗结合的原则（D对）（B错，为本题正确答案）。中医药在传染病防治方面，尤其是病毒性传染病防治方面已显示出较好的疗效（E对）。